营养不良的诊断依据应除外
A. 皮下脂肪减少
B. 体重低于正常均值10%以上
C. 智力低下
D. 有喂养不当史
E. 各器官功能低下

正确答案：C。智力低下

解析：本题考查营养不良的诊断依据。智力低下（C错，为本题正确答案）属于智力发育的诊断依据。营养不良的诊断依据：1.皮下脂肪减少（A对）；2.体重低于正常均值10%以上（B对）；3.有喂养不当史（D对）；4.各器官功能低下（E对）。